下列叙述中，哪条不是队列研究的特点
A. 能直接估计因素和疾病的关联强度，可计算发病率
B. 暴露人年的计算繁重
C. 结果可靠，多用于罕见疾病
D. 队列研究每次只列因素一个或一组
E. 因素的作用可分为等级，以便计算剂量—反应关系

正确答案：C。结果可靠，多用于罕见疾病